拔除下颌双尖牙宜采用
A. 局部浸润麻醉+下牙槽神经阻滞麻醉
B. 下牙槽神经阻滞麻醉+舌神经阻滞麻醉+颊神经阻滞麻醉
C. 颊神经+舌神经阻滞麻醉
D. 下牙槽神经+颊神经阻滞麻醉
E. 颊神经及舌神经阻滞麻醉+局部浸润麻醉

正确答案：B。下牙槽神经阻滞麻醉+舌神经阻滞麻醉+颊神经阻滞麻醉

解析：本题考查下颌神经在口腔的分布。下颌双尖牙的唇颊侧牙龈、黏骨膜由下牙槽神经和颊神经共同支配，舌侧牙龈、黏骨膜由舌神经支配，可采用下牙槽神经+舌神经阻滞麻醉+颊神经阻滞麻醉（B对）。